位于牙颈部周围的游离龈中，呈环形排列。纤维比其他牙龈组要细的是
A. 龈牙组
B. 牙槽龈组
C. 环形组
D. 牙骨膜组
E. 越隔组

正确答案：C。环形组

解析：环形组位于牙颈部周围的游离龈中，呈环形排列。纤维比其他组要细，常与邻近的其他纤维束缠绕在一起，有助于游离龈附着于牙上。掌握“牙龈”知识点。